仅含感觉纤维成分的是
A. 脊神经的后根
B. 脊神经的前根
C. 脊神经的前支
D. 脊神经的后支
E. 脊神经

正确答案：A。脊神经的后根

解析：脊神经前根（B错）由运动性神经根丝构成，后根（A对）由感觉性神经根丝构成，脊神经（E错）属于混合性神经。脊神经前支和后支（CD错）均为混合性神经支。